可氧化成亚砜或砜，使极性增强的官能团是
A. 羟基
B. 硫醚
C. 羧酸
D. 卤素
E. 酰胺

正确答案：B。硫醚

解析：本题考查药物的典型官能团对生物活性影响。硫醚（B对）可氧化成亚砜或砜，它们的极性强于硫醚。药物分子中引入羟基（A错），可增加亲水性，改变溶解度、解离度、分配系数，还可增加位阻，从而增加稳定性。羧酸（C错）易成酯，成酯后脂溶性增大，易透过生物膜被吸收。卤素（D错）是很强的吸电子基，可增加脂溶性，延长药物作用时间。酰胺（E错）类药物可与生物大分子形成氢键，增强与受体的结合能力。